下列除哪项外，均是自发性心绞痛的临床特点
A. 血清酶一般正常
B. 可持续15～30分钟
C. 休息或夜间发作
D. 心电图出现异常Q波
E. 含服硝酸甘油片不易缓解

正确答案：D。心电图出现异常Q波

解析：自发性心绞痛心绞痛发作与体力或脑力负荷引起心肌需氧量增加无明显关系，而与冠状动脉血流贮备量减少有关，为心肌一过性缺血所致，其临床特点为：①血清酶一般正常如肌钙蛋白酶一般正常（A对）；②可持续15～30分钟（B对）；③休息或夜间发作（C对）；④含服硝酸甘油片不易缓解（E对）。心电图出现异常Q波（D错，为本题正确答案）是心肌梗死的临床特点。